ANP主要存在于
A. 心房肌细胞
B. 心室肌细胞
C. 窦房结
D. 下丘脑
E. 垂体

正确答案：A。心房肌细胞

解析：心房钠尿肽（ANP）是由心房肌细胞（A对）合成并分泌的肽类激素，能够使血管平滑肌舒张和促进肾脏排钠排水。当心房扩展、血容量增加、血Na＋增高或血管紧张素增多时，将刺激心房肌细胞合成和释放ANP。ANP 释放入血后，主要从四个方面影响水钠代谢：减少肾素的分泌；抑制醒固酮的分泌；对抗血管紧张素的缩血管效应；拮抗醛固酮的滞Na＋作用。